硝酸甘油口服给药效果差，舌下含服起效迅速，导致这种差异的原因在影响药物作用因素中属于
A. 给药途径因素
B. 药物剂量因素
C. 精神因素
D. 给药时间因素
E. 遗传因素

正确答案：A。给药途径因素

解析：本题考查影响药物的作用因素。不同的给药途径（A对）会影响药物的吸收和分布，从而影响药效。硝酸甘油舌下含服经口腔黏膜迅速吸收，无首关效应，吸收效果好。